男性，39岁，既往曾有“蛋白尿”病史，一直未做系统治疗。近三周来出现恶心、呕吐，查体：血压190/120mmHg，轻度水肿，血肌酐360μmol/L，B超双肾缩小。不应进行下列哪项检查
A. 血常规
B. 心电图检查
C. 血电解质
D. 静脉肾盂造影
E. 内生肌酐清除率

正确答案：D。静脉肾盂造影

解析：患者蛋白尿、高血压、水肿诊断为肾炎，血肌酐升高出现肾衰竭，静脉肾盂造影对于慢性肾衰竭的诊断及病情的观察没有意义。掌握“急性肾孟肾炎、尿路结石及慢性肾衰竭”知识点。